肝硬化失代偿期突出的临床表现是
A. 肝掌
B. 脾大
C. 腹水
D. 腹胀
E. 蜘蛛痣

正确答案：C。腹水

解析：腹水：是肝功能减退和门脉高压的共同结果，是肝硬化失代偿期最常见和最突出的表现。掌握“肝硬化”知识点。